下列哪种纤维属于联络纤维
A. 胼胝体
B. 钩束
C. 丘脑中央辐射
D. 额桥束
E. 穹窿

正确答案：B。钩束

解析：联络纤维是联系同侧半球内各部分皮质的纤维，主要由钩束（B对）、上纵束、下纵束、扣带组成。胼胝体（A错）和穹隆（E错）为连合纤维。